一屠宰工人，咳嗽，咯血伴发热，结膜充血，腓肠肌疼痛，淋巴结肿大和黄疸同时有中性粒细胞增高，血小板减少，而脑脊液无色透明。应考虑的疾病是
A. 流行性出血热
B. 白血病
C. 肺梗死
D. 血友病
E. 钩端螺旋体病

正确答案：E。钩端螺旋体病

解析：患者屠宰工人，咳嗽，咯血伴发热，结膜充血，腓肠肌疼痛，淋巴结肿大和黄疸同时有中性粒细胞增高，血小板减少，而脑脊液无色透明，判断为钩端螺旋体病（E对）。流行性出血热又称肾综合征出血热，是危害人类健康的重要传染病，是由流行性出血热病毒（汉坦病毒）引起的，以鼠类为主要传染源的自然疫源性疾病。以发热、出血、充血、低血压休克及肾脏损害为主要临床表现（A错）。白血病起病急缓不一。急性白血病可能出现突然高热，也可以是严重出血；慢性白血病一般进展较慢，患者可能有面色苍白、淋巴结和脾脏肿大，月经过多或拔牙后出血难止等表现。急性白血病多数患者就诊时就已有中重度贫血，部分急性白血病患者病程短，可无贫血。发热和感染，半数患者以发热为早期表现，可低热，也可高达39℃～40℃以上。高热常提示有继发感染。出血可发生在全身各部位，以皮肤瘀斑、鼻出血、牙龈出血、月经过多常见。颅内出血、消化道出血、泌尿系出血虽少见，但后果严重。白血病细胞增殖浸润表现淋巴结和脾肿大：淋巴结肿大为淋巴细胞白血病的显著特征，以急性淋巴细胞白血病较多见。脾脏肿大在急性白血病中可较多见。骨骼和关节疼痛：骨痛是白血病常见的体征之一，常比较剧烈，部位不固定，主要见于胸骨、四肢骨、脊柱和骨盆。使用止痛药效果不佳。口腔和皮肤：常见于急性白血病，表现为牙龈增生、肿胀或牙龈出血。局部皮肤隆起、变硬，呈紫蓝色结节。慢性白血病主要分为慢性髓系白血病和慢性淋巴细胞白血病。慢性髓系白血病患者有乏力、低热、多汗或盗汗、体重减轻等代谢亢进的症状。常以脾脏肿大为最显著体征。当白细胞显著增高时，可有眼底充血及出血。在疾病加速期，常有发热、虚弱、进行性体重下降、骨骼疼痛，逐渐出现贫血和出血，加速期可维持几个月到数年。慢性淋巴细胞白血病，起病缓慢，患者多在体检或因其他疾病就诊时发现。有症状者早期可表现为乏力、疲倦，而后出现食欲减退、消瘦、低热、盗汗等。60%～80%的患者有淋巴结肿大，多见于头颈部、锁骨等处。半数以上的患者有轻至中度的脾大，轻度肝大等症状。晚期患者可出现贫血、血小板减少和粒细胞减少（B错）。肺梗死是肺栓塞后因血流阻断而引起的肺组织坏死，引起肺栓塞的常见栓子是深静脉血栓，临床表现为胸闷、气短、呼吸困难、胸痛、低热、咳血。它发病突然，来势凶猛，病情危重，死亡率高（C错）。血友病的主要症状是出血，它的出血主要是关节深层肌肉的出血，可能会导致关节疼痛、肿胀，甚至影响患者的行走，从而对该功能造成障碍，外伤或手术后出血延迟，轻度血友病如果外伤，其中破裂，可能会出现大量出血，磕碰后流血不止、关节局部红肿、活动受限，血友病患者的凝血功能具有障碍（D错）。